适合采用平均倒凹法确定就位道的是
A. 后牙游离缺失
B. 前牙缺失
C. 一侧后牙非游离缺失
D. 前、后牙同时缺失
E. 缺牙间隙多，倒凹大

正确答案：E。缺牙间隙多，倒凹大

解析：平均倒凹（均凹法）：对于缺牙间隙多、倒凹大的病例，应采用平均各基牙倒凹的垂直向就位道。掌握“局部义齿类型，肯氏分类及模型观测”知识点。